下列哪种情况下，可使心排出量增加
A. 心迷走神经兴奋时
B. 颈动脉窦压力升高时
C. 动脉血压升高时
D. 使用去甲肾上腺素时
E. 使用肾上腺素时

正确答案：E。使用肾上腺素时